下述哪项不是队列研究的特点
A. 可直接计算发病率
B. 多数情况下要计算人年发病（死亡）率
C. 多用于罕见病
D. 每次调查能同时研究几种疾病
E. 因素可分为几个等级，以便计算剂量-反应关系

正确答案：C。多用于罕见病

解析：本题考查队列研究的特点。队列研究的特点包括：①可直接计算发病率（A对）；②多数情况下要计算人年发病（死亡）率（B对）；③每次调查能同时研究几种疾病（D对）；④因素可分为几个等级，以便计算剂量-反应关系（E对）。队列研究不适用于罕见病的研究（C错，为本题正确答案）。